伤寒最严重的并发症是
A. 肠出血
B. 中毒性心肌炎
C. 肺炎
D. 肠穿孔
E. 胆囊炎

正确答案：D。肠穿孔